关于美罗培南使用注意事项的说法，错误的是
A. 肝功能不全者需调整剂量
B. 可用于治疗妊娠期呼吸系统感染
C. 有其它β-内酰胺类药物过敏性休克史的患者禁用
D. 与中枢神经系统γ-氨基丁酸受体的亲和力较亚胺培南弱，故癫痫等中枢神经系统不良反应的发生率显著低于亚胺培南
E. 与丙戊酸钠合用时，可导致后者血浆药物浓度下降至有效浓度以下，甚至引起癫痫发作

正确答案：A。肝功能不全者需调整剂量

解析：本题考查美罗培南。肝功能损害患者应用美罗培南时不需调整剂量（A错，为本题正确答案）。美罗培南主要用于多重耐药革兰阴性杆菌感染、严重需氧菌与厌氧菌混合性感染，以及病原未查明严重感染患者的经验性治疗。美罗培南治疗严重铜绿假单胞菌感染时宜与其它抗铜绿假单胞菌药物联合应用。美罗培南还可用于治疗妊娠期呼吸系统感染（B对），有其它β-内酰胺类药物过敏性休克史的患者禁用（C对）。美罗培南与中枢神经系统γ-氨基丁酸受体的亲和力较亚胺培南弱，故癫痫等中枢神经系统不良反应的发生率显著低于亚胺培南（D对）。美罗培南与丙戊酸钠合用时，可导致后者血浆药物浓度下降至有效浓度以下，甚至引起癫痫发作（E对）。